慢性龈炎的病理变化主要有
A. 牙龈上皮出血
B. 牙龈上皮增生
C. 牙龈上皮脓肿
D. 龈沟壁处有炎症细胞浸润
E. 沟内上皮向根方增殖

正确答案：D。龈沟壁处有炎症细胞浸润

解析：本题考查慢性龈炎的病理变化。慢性龈炎的病理变化主要有龈沟壁处有炎症细胞浸润（D对）。在沟内上皮的下方可见中性粒细胞浸润，再下方为大量的淋巴细胞。炎症细胞浸润区域的胶原纤维大多变性或丧失。牙龈上皮出血（A错）多见于慢性龈炎的炎症水肿型；牙龈上皮增生（B错）多见于慢性龈炎的纤维增生型。慢性龈炎一般不会出现牙龈上皮脓肿（C错）和沟内上皮向根方增殖（E错）。